引起生物地球化学疾病的原因是
A. 某些生物病原体的污染
B. 工业企业排放物的污染
C. 某些病原体与化学污染物的污染
D. 生活废弃物的污染
E. 土壤或水中某些元素过高或过低

正确答案：E。土壤或水中某些元素过高或过低

解析：生物地球化学性疾病是由于地壳表层化学元素分布不均引起土壤或水中某些元素过高或过低（E对），进而引起某些特异性疾病（碘缺乏病、地方性氟中毒、地方性砷中毒等）。生物病原体污染（A错）、工业企业排放物污染（B错）、病原体与化学污染物污染（C错）和生活废弃物污染（D错）引起的是大气、水和土壤的环境污染。